易虫蛀的常见剂型是
A. 蜜丸
B. 片剂
C. 栓剂
D. 颗粒剂
E. 胶囊剂

正确答案：A。蜜丸

解析：本题考查的是中成药贮存中常见的质量变异现象。易虫蛀的常见剂型是蜜丸（A对）。中成药贮存中常见的质量变异现象：养护不当也会发生变质，并往往与剂型有关。最常见的变质现象有虫蛀、霉变、酸败、挥发、沉淀等。1.虫蛀：虫蛀与原料药的性质及在生产、运输、贮存中受到污染等因素有关，一旦遇到适宜的气候环境就会发生。易虫蛀的常见剂型有蜜丸、水丸、散剂等。2.霉变：易霉变的常见剂型有蜜丸、膏滋、片剂（B错）等。3.酸败：易发生酸败的剂型有合剂、酒剂、煎膏剂、糖浆剂、软膏剂等。4.挥发：挥发，是指在高温下中成药所含挥发油或乙醇的散失。如芳香水剂、酊剂等。5.沉淀：沉淀，是液体制剂的一种常见变质现象。中成药的液体制剂，在温度和pH值的影响下易发生沉淀，常见的剂型有药酒、口服液、注射液等。栓剂（C错）易变形、发霉、变质。颗粒剂（D错）易受潮结块、潮解、发霉。胶囊剂（E错）易发霉、粘连，甚至软化、破裂。